对乳腺手术预防感染应用抗菌药物应选用
A. 头孢唑林
B. 头孢他嗪
C. 美罗培南
D. 万古霉素
E. 头孢呋辛+甲硝唑

正确答案：A。头孢唑林

解析：本题考查抗菌药物的选择。对乳腺手术预防感染应用抗菌药物应选用头孢唑林（A对）。